患者32岁，左侧下后牙疼痛就诊。查左下6（牙合）面见银汞充填，叩诊轻度疼痛，冷刺激迟缓性疼痛，X线片示：充填物已达髓腔，未见根充影像，根尖情况正常。诊断为
A. 慢性根尖周炎
B. 可复性牙髓炎
C. 残髓炎
D. 深龋
E. 急性牙髓炎

正确答案：C。残髓炎

解析：本题考查残髓炎。X线片示：充填物已达髓腔，未见根充影像说明龋坏已达牙髓，但未进行完善的根管治疗。冷刺激迟缓性疼痛，说明根管中有少量残留牙髓。根尖情况正常叩诊轻度疼痛，说明炎症未累及根尖所以该病为残髓炎（C对）。慢性根尖周炎（A错） X线片示根尖区有透射影像。可复性牙髓炎（B错）冷热刺激一过性疼痛，疼痛去除后疼痛立即消失，无冷刺激迟缓性疼痛。深龋（D错）时温度刺激进入龋洞时才会出现激发痛，且髓腔完好。急性牙髓炎（E错）有自发痛，阵发痛、冷热刺激痛、夜间痛、放射痛、不定位痛。